男，40岁，突发心脏骤停，经心肺复苏后血压85/55mmHg，心率34次/分，应首选什么药物
A. 利多卡因
B. 胺碘酮
C. 阿托品
D. 西地兰
E. 多巴酚丁胺

正确答案：C。阿托品

解析：该患者男，40岁，突发心脏骤停，经心肺复苏后血压85/55mmHg，心率34次/分，患者出现严重的心动过缓，结合患者的表现，应首选阿托品（C对）。